患者，男，63岁，吸烟10余年，近1年来出现气喘，呼吸困难，咳嗽咯痰，胸部视诊胸廓前后径增大，肋间隙增宽，两肺听诊呼吸音减弱，呼气延长。其诊断是
A. 慢性阻塞性肺疾病
B. 肺结核
C. 支气管肺癌
D. 支气管哮喘
E. 支气管扩张

正确答案：A。慢性阻塞性肺疾病

解析：慢性阻塞性肺疾病的病人随着病情的进展会出现一系列阳性体征，包括桶状胸，肋间隙增宽，双肺震颤减弱，肝浊音界下降等，在听诊的时候可闻及干湿性啰音等（A对）。咳嗽、咯痰是肺结核患者最常见症状，患者有不同程度咯血，通常为少量咯血或痰中带血，少数大咯血，当有较大范围的纤维条索形成时，气管向患侧移位，患侧胸廓塌陷、叩诊浊音、听诊呼吸音减弱并可闻及湿啰音（B错）。支气管肺癌患者出现原因不明、久治不愈的肺外征象，如杵状指（趾）、非游走性关节疼痛、男性乳腺增生、皮肤黝黑或皮肌炎、共济失调和静脉炎等，临床表现高度可疑肺癌的患者，体检发现肝肿大伴有结节、皮下结节、锁骨上窝淋巴结肿大等，提示远处转移的可能（C错）。支气管哮喘发作时胸部呈过度充气状态，双肺广泛哮鸣音，呼气音延长（D错）。咳嗽是支气管扩张症最常见的症状，且多伴有咳痰，早期或干性支气管扩张症患者可无异常体征，病变重或继发感染时下胸部、背部可听到固定而持久的局限性粗湿啰音，有时可闻及哮鸣音（E错）。